某男半小时前被热气灼伤两前臂，现局部疼痛剧烈，有散在水疱，个别破溃，基底部呈均匀红色、潮湿。其诊断是
A. 面积约为6%的浅II度烧伤
B. 面积经为4.5%的II度烧伤
C. 面积约为9%的III度烧伤
D. 面积约为9%的I度烧伤
E. 面积约为9%的深II度烧伤

正确答案：A。面积约为6%的浅II度烧伤

解析：患者前臂被灼伤后出现剧痛,散在水疱,基底部呈均匀红色潮湿,未伤及真皮层,符合浅Ⅱ度烧伤的诊断,根据图表15-2,可知前臂所占面积为3%,所以两只前臂所占面积为6%（A对B错）。III度烧伤可见焦痂（C错）。I度烧伤表面干燥,无水疱(D错)。深II度烧伤有水疱，基底部苍白（E错）。